超低出生体重新生儿的出生体重低于
A. 2000g
B. 2500g
C. 800g
D. 1500g
E. 1000g

正确答案：E。1000g

解析：BW﹤1000g称为超低出生体重儿（E对）。